喉位于颈前部中份，以软骨为支架，各软骨借关节、韧带及纤维膜相连接，内衬黏膜，并有喉肌附着。喉既是呼吸道，又是发音器官。喉的内腔为喉腔，向上通咽，向下通气管。喉软骨中惟一完整的软骨环是
A. 甲状软骨
B. 会厌软骨
C. 环状软骨
D. 杓状软骨
E. 以上均不是

正确答案：C。环状软骨

解析：环状软骨（C对）是喉软骨中惟一完整的软骨环。